男，33岁，主诉：近1～2年来自觉全口牙齿松动，咀嚼力量减弱，前牙出现移位。最可能的初步印象为
A. 慢性牙周炎
B. 快速进展型牙周炎
C. 青少年牙周炎
D. 急性多发性牙周脓肿
E. 急性坏死性龈炎

正确答案：B。快速进展型牙周炎

解析：本题考查侵袭性牙周炎。根据病例描述，患者33岁，近1～2年来自觉全口牙齿松动，咀嚼力量减弱，前牙出现移位，可知患牙病程进展迅速，波及范围广，牙齿松动程度严重，则可考虑为快速进展型牙周炎（B对）。慢性牙周炎（A错）主要由菌斑牙石长期刺激所致，病程进展缓慢，不会在1～2年就出现全口牙齿松动和前牙移位，故不考虑此诊断。青少年牙周炎（C错）是发生于青少年时期的牙周组织的快速进展性破坏，牙槽骨吸收多局限于第一磨牙和切牙，病例中患者年纪33岁，且全口牙都有松动表现，故不考虑此诊断。急性多发性牙周脓肿（D错）主要表现为在患牙的唇颊侧或舌腭侧牙龈形成半球形或椭圆形的肿胀突起，牙龈红肿，伴有全身不适症状，病例中未诉全身不适症状，故不考虑此诊断。急性坏死性龈炎（E错）起病急，病程短，牙龈自动出血，腐败性口臭，牙龈乳头消失呈刀切状，下前牙龈缘虫蚀状坏死，有假膜覆盖，且多伴有全身症状，一般不会引起牙松动，故不考虑此诊断。